患儿，5岁。发热一天，颜面，躯干见丘疹及水疱疹，现低热恶寒，鼻塞流涕，疹色红润，疮浆清亮，点粒稀疏，舌质红，苔薄白，脉浮数。其病证诊断是
A. 风疹，邪郁肺卫
B. 麻疹，初热期
C. 幼儿急疹，肺卫蕴热
D. 猩红热，毒在气营
E. 水痘，邪郁肺卫

正确答案：E。水痘，邪郁肺卫

解析：患儿发热，鼻塞流涕，颜面，躯干见丘疹及水疱疹现低热恶寒，疹色红润，疮浆清亮，点粒稀疏，诊断为水痘，邪郁肺卫证。水痘时邪从口鼻而入，侵犯肺卫，则肺卫失宣，出现发热、流涕、咳嗽等肺卫表证；肺主皮毛，脾主肌肉，邪正交争，水痘时邪夹湿透于肌表，则水痘布露。因病尚在表，故水痘稀疏，疹色红润，疱浆清亮（E对）。风疹邪郁肺卫证候：发热恶风，喷嚏流涕，轻微咳嗽，胃纳欠佳，精神倦怠，疹色淡红，稀疏细小，分布均匀，微有痒感，耳后、枕后及颈部淋巴结肿大，舌尖红，苔薄黄，脉浮数（A错）。麻疹，初热期邪犯肺卫证候：发热恶风，鼻塞流涕，喷嚏，咳嗽，眼睑红赤，泪水汪汪，畏光羞明，体倦食少，小便短黄，或大便稀溏，发热2～3天在口腔颊部近臼齿处出现麻疹黏膜斑，舌苔薄白或微黄，脉浮数（B错）。幼儿急疹邪郁肌表证候：突然高热，多为39℃～40℃，但精神如常，或略烦躁，食欲略差，尿黄，或见呕吐，腹痛，泄泻，咽红、舌红，苔薄黄，指纹浮紫（C错）。猩红热毒炽气营证候：壮热不解，面赤，口渴，咽喉肿痛，伴糜烂白腐，皮疹密布，色红如丹，甚则色紫。疹由颈、胸开始，继则弥漫全身，压之退色，见疹后的1～2天苔黄燥，舌红起刺，3～4天后苔剥脱，舌光红起刺，状如杨梅。脉数有力（D错）。